含有儿茶酚胺结构，易被氧化变质的肾上腺素能药物是
A. 肾上腺素
B. 重酒石酸间羟胺
C. 沙丁胺醇
D. 沙美特罗
E. 盐酸麻黄碱

正确答案：A。肾上腺素

解析：本题考查药物的降解途径。含有儿茶酚胺结构，易被氧化变质的肾上腺素能药物是肾上腺素（A对）。肾上腺素是具有儿茶酚胺结构的酚类物质，极易被氧化，具有肾上腺素能作用。重酒石酸间羟胺（B错）主要作用于α受体，对β₁受体作用较弱，部分作用是通过促进交感神经末梢释放去甲肾上腺素。沙丁胺醇（C错）含有叔丁胺基结构，为选择性β受体激动剂；沙美特罗（D错）作用于β受体。盐酸麻黄碱（E错）是拟肾上腺素能药物，属于苯异丙胺类，苯环上无酚羟基结构。